治疗脊髓损伤引起肌强直的药物是
A. 乙琥胺
B. 地西泮
C. 氯丙嗪
D. 苯妥英钠
E. 异丙嗪

正确答案：B。地西泮

解析：地西泮（B对）是苯二氮䓬类药物，可缓解人类大脑损伤所致的肌肉僵直。乙琥胺（A错）适用于小发作（失神性发作）。氯丙嗪（C错）适用于精神分裂症、呕吐和顽固性呃逆、低温麻醉与人工冬眠。苯妥英钠（D错）是大发作和局限性发作的首选药物。异丙嗪（E错）是吩噻嗪类抗组胺药，适用于镇吐、抗晕动以及镇静催眠。